风湿性心瓣膜病并发感染性心内膜炎时，最支持感染性心内膜炎诊断的是
A. 体温38.5℃
B. 胸痛并有胸膜摩擦音
C. 超声心动图显示有赘生物
D. 白细胞增高
E. 心电图ST-T改变

正确答案：C。超声心动图显示有赘生物

解析：感染性心内膜炎主要诊断标准为血培养阳性和心内膜受累证据，超声心动图显示有赘生物（C对）为心内膜受累证据，最支持感染性心内膜炎诊断。体温体温38.5度（≥38℃）（A错），为次要标准；胸痛并有胸膜摩擦音（B错）常提示有胸膜炎症；白细胞增高（D错）多提示存在感染；心电图ST-T改变（E错）常见心肌缺血等疾病，这四种表现均缺乏诊断特异性。